西咪替丁
A. 对热不稳定
B. 在过量的盐酸中比较稳定
C. 口服吸收不好，只能注射给药
D. 与雌激素受体有亲和作用而产生副反应
E. 极性较小，脂溶性较大

正确答案：E。极性较小，脂溶性较大